影响药物分布的因素有
A. 药物理化性质
B. 体液pH
C. 血脑屏障
D. 胎盘屏障
E. 血浆蛋白结合率

正确答案：A、B、C、D、E。药物理化性质；体液pH；血脑屏障；胎盘屏障；血浆蛋白结合率

解析：本题考查影响药物分布的因素。药物在组织的分布受到体液pH（B对）、药物的理化性质（A对）、血浆蛋白结合率（E对）等因素的影响；血脑屏障（C对）为药物与脑组织之间的屏障；胎盘屏障（D对）是将母体与胎儿血液隔开的屏障。